患者，男，右侧腮腺区反复肿胀3年，腮腺区发胀，口内时有咸味。如诊断为慢性阻塞腮腺炎，挤压右侧腮腺可从导管口流出
A. 雪花样唾液
B. 棕色唾液
C. 清亮唾液
D. 导管口红肿
E. 无唾液

正确答案：A。雪花样唾液

解析：本题考查慢性阻塞性腮腺炎。临床检查腮腺稍增大，能扪到肿大的腮腺轮廓，中等硬度，轻微压痛。导管口轻微红肿，挤压腮腺可从导管口流出混浊的“雪花样”或黏稠的蛋清样唾液（A对），有时可见黏液栓子。本题考查慢性阻塞性腮腺炎。